含芦丁的是
A. 槐花
B. 银杏叶
C. 满山红
D. 陈皮
E. 黄芩

正确答案：A。槐花

解析：本题考查中药的主要化学成分。含芦丁的是槐花（A对）。槐米含有芦丁、槲皮素、皂苷、白桦脂醇、槐二醇、槐米甲素、槐米乙素、槐米丙素和黏液质等。银杏叶（B错）中的主要化学成分为黄酮类和萜内酯类化合物。从满山红（C错）叶中已分离出杜鹃素、8-去甲基杜鹃素、山柰酚、槲皮素、杨梅素、金丝桃苷等。陈皮（D错）中除含有挥发油外，还含有多种黄酮类化合物，其中橙皮苷具有和芦丁相同的用途，也有维生素P样功效，多制成甲基橙皮苷供药用，是治疗冠心病的药物“脉通”的重要原料之一。《中国药典》以橙皮苷为指标成分对陈皮进行含量测定。从黄芩（E错）中分离出来的黄酮类化合物有黄芩苷（含4.0%～5.2%）、黄芩素、汉黄芩苷、汉黄芩素等。其中黄芩苷是主要有效成分。